治疗耳聋外感风邪证，除主穴外，还应选用配穴是
A. 丰隆、脾俞
B. 足三里、三阴交
C. 太冲、丘墟
D. 外关、合谷
E. 风门、肺俞

正确答案：D。外关、合谷

解析：耳聋外感风邪证，治宜疏风泻火，通络开窍。以局部穴及手足少阳经穴为主。主穴选用听会、翳风、中渚、侠溪，可配风池、外关、合谷。手足少阳之脉均绕行于耳之前后并入耳中，听会属足少阳经，翳风属手少阳经，两穴均居耳周，可疏导少阳经气，主治耳疾；循经远取侠溪、中渚，可通上达下，疏导少阳经气，宣通耳窍。外关穴为手少阳之络穴，又为八脉交会穴之一，通阳维脉，主治热病、头痛、目赤肿痛、耳鸣、耳聋等头面部五官疾病，瘰疬，胁肋痛，落枕、扭伤、上肢痿痹不遂等症。合谷是手阳明大肠经的原穴，也就是人体元气经过和留止的部位。经常按摩此穴，有通经活络，清热解表，镇静止痛的作用，主要用来治疗头痛、目赤肿痛、鼻出血、齿痛、耳聋等（D对）。